女性，42岁，反复腹胀，乏力，纳差三年。11周来出现发热，腹部隐痛，腹围显著增大，既往乙肝肝炎病史15年。查体：慢性肝病面容，肝掌，腹部膨隆，弥漫性压痛，反跳痛。肝肋下未触及，脾肋下3cm，移动性浊音阳性，白细胞15×10⁹/L，N0.85，Scr：104μmol/L。BUN：6.6mmol/L。最可能腹痛的原因
A. 自发性腹膜炎
B. 门静脉血栓
C. 原发性肝癌
D. 肝肾综合征
E. 继发性腹膜炎

正确答案：A。自发性腹膜炎

解析：该患者女性，42岁，既往有乙肝肝炎病史（肝硬化的病因），出现反复腹胀，乏力，纳差，肝掌，腹部膨隆（肝硬化表现），查体：慢性肝病面容，弥漫性压痛，反跳痛，发热(自发性腹膜炎的表现)，腹部隐痛，腹围显著增大，肝肋下未触及，脾肋下3cm，移动性浊音阳性，白细胞15×109/L（白细胞正常值：4～10×109/L，白细胞增加，有感染症状），N0.85，Scr104。BUN6.6mmol/L，结合患者的病因、表现、体征和辅助检查，患者最可能腹痛的原因是自发性腹膜炎（A对）。（P414）门静脉血栓对新近发生的血栓应做早期静脉肝素抗凝治疗，可使80%以上病人出现完全或广泛性再通，口服抗凝药物治疗至少维持半年。对早期的门静脉血栓也可采用经皮、经股动脉插管至肠系膜上动脉后置管，用微量泵持续泵入尿激酶进行早期溶栓，使门静脉再通TIPS适用于血栓形成时间较长出现机化的病人（B错）。（P416）肝区疼痛是肝癌最常见的症状，多呈右上腹持续性胀痛或钝痛，与癌肿生长、肝包膜受牵拉有关。如病变侵犯膈，疼痛可牵涉右肩或右背部（C错）。肝肾综合征TIPS有助于减少缓进型转为急进型。肝移植可以同时缓解这两型肝肾综合征，是该并发症有效的治疗方法。在等待肝移植术的过程中，可以采取如下措施保护肾功能：静脉补充清蛋白、使用血管加压素、TIPS、血液透析以及人工肝支持等（D错）。继发性腹膜炎是在有原发病基础上发生的，如阑尾、十二指肠、急性胆囊炎穿孔，引起的腹部感染，最常见的致病菌是大肠埃希菌（E错）。